临床上出现周缘扩展现象和尼氏征阳性的病变是
A. 脓疱
B. 血疱
C. 水疱
D. 基层下疱
E. 棘层内疱

正确答案：E。棘层内疱

解析：用手指轻推外表正常的皮肤与黏膜，即可迅速形成水疱.或使原有的水疱在皮肤上移动。这种现象称尼科尔斯基征，即尼氏征阳性。常见于天疱疮。掌握“口腔黏膜基本病理变化”知识点。